天疱疮的病理表现不包括
A. 棘细胞层松解
B. 上皮内疱
C. 上皮下疱
D. 棘细胞间间桥消失
E. 固有层有炎症细胞浸润

正确答案：C。上皮下疱

解析：天疱疮病理变化：天疱疮的病理特征为棘层松解和上皮内疱形成。由于上皮细胞间水肿，细胞间桥消失，使棘层细胞松解，彼此分离，在上皮内形成裂隙或出现大疱，其部位常在棘层内或棘层和基底层之间。掌握“天疱疮”知识点。